既含雄黄又含朱砂的中成药是
A. 六神丸
B. 抱龙丸
C. 天王补心丸
D. 朱砂安神丸
E. 牛黄清心丸

正确答案：E。牛黄清心丸

解析：本题考查的是同时含雄黄和朱砂的中成药。既含雄黄又含朱砂的中成药是牛黄清心丸（E对）。含雄黄的中成药：牛黄解毒丸（片）、六神（A错）丸、喉症丸、安宫牛黄丸、牛黄清心丸、牛黄镇惊丸、牛黄抱龙丸、牛黄至宝丸、追风丸、牛黄醒消丸、紫金锭（散）、三品等。含朱砂、轻粉、红粉的中成药：牛黄清心丸、牛黄抱龙丸、抱龙丸（B错）、朱砂安神丸（D错）、天王补心丸（C错）、安神补脑丸、苏合香丸、人参再造丸、安宫牛黄丸、牛黄千金散、牛黄镇惊丸、紫雪散、梅花点舌丸、紫金锭（散）、磁朱丸、更衣丸、复方芦荟胶囊。